氟中毒的发病特点具有明显的地区性，故又称
A. 地方病
B. 原生环境
C. 次生环境
D. 传染病
E. 感染性疾病

正确答案：A。地方病

解析：原生环境中某种元素含量异常，也会对当地居民身体健康产生不良的影响，如某地区氟的含量过高就会导致氟中毒，即生物地球化学性疾病，这类疾病的发病特点具有明显的地区性，故又称地方病。掌握“环境卫生与职业卫生”知识点。